属于5α-还原酶抑制剂，可抑制前列腺生长的药品
A. 黄酮哌酯
B. 氟他胺
C. 特拉唑嗪
D. 非那雄胺
E. 尼尔雌醇

正确答案：D。非那雄胺

解析：本题考查抗前列腺增生药。5α-还原酶抑制剂如非那雄胺（D对），可诱导前列腺上皮细胞的凋亡，抑制前列腺生长，使前列腺体积缩小。黄酮哌酯（A错）为抗前列腺增生药。氟他胺（B错）为雄激素受体阻断剂。特拉唑嗪（C错）是异丙肾上腺素α-受体阻断剂。尼尔雌醇（E错）是口服长效雌激素。